对轴嵴的解释哪一个是正确的
A. 牙釉质的长形线状隆起
B. 轴面与轴面相交所形成的长形线状隆起
C. 在唇、颊面上的长形线状隆起
D. 在轴面上，从牙尖顶端伸向牙颈部的纵形隆起
E. （牙合）面与轴面相交的长形隆起

正确答案：D。在轴面上，从牙尖顶端伸向牙颈部的纵形隆起

解析：轴嵴是在轴面上，从牙尖顶端伸向牙颈部的纵行隆起。嵴：牙冠表面细长形的釉质隆起。掌握“牙的萌出、更替及牙体解剖名词、标志”知识点。